对甲状腺结节的诊断，首先进行的辅助检查是
A. 放射性核素扫描
B. 甲状腺B超
C. 穿刺细胞学
D. 颈部MRI
E. 颈部CT

正确答案：B。甲状腺B超

解析：首先进行的辅助检查是甲状腺B超（B对），具有无创、方便、费用低廉、无放射性、可重复性强等优点，并且甲状腺B超能明确结节的数目、位置、大小、形态、边界及与周围组织的关系，还能提供结节的血供情况，有助于结节良恶性的鉴别。放射性核素扫描目前临床上已少用（A错）。细针穿刺细胞学（C错）检查是明确结节性质的首选辅助检查。颈部MRI（D错）、颈部CT（E错）价格昂贵，不作为首选。